影响龋病发生的因素有
A. 细菌
B. 易感牙面
C. 食物
D. 一定的时间
E. 以上因素均有

正确答案：E。以上因素均有

解析：本题考查四联因素学说。龋病时一种多因素、慢性感染性疾病，目前公认的龋病发生的机制为四联因素理论。细菌（A对）的存在为龋病先决条件，食物（C对）尤其是蔗糖在龋病发病中有重要地位，加之宿主的易感性包括唾液的流速流量、成分及易感的牙面（B对）如（牙合）面窝沟等，在一定的时间（D对）作用下，共同导致龋病的发生。（ABCD均对，故E为本题的正确答案）。